药用部位为根茎及根的药材是
A. 黄芪
B. 虎杖
C. 板蓝根
D. 牛膝
E. 党参

正确答案：B。虎杖

解析：本题考查的是虎杖的来源。药用部位为根茎及根的药材是虎杖（B对）。虎杖：【来源】为蓼科植物虎杖的干燥根茎及根。黄芪（A错）：【来源】为豆科植物蒙古黄芪或膜荚黄芪的干燥根。板蓝根（C错）：【来源】为十字花科植物菘蓝的干燥根。牛膝（D错）：【来源】为苋科植物牛膝的干燥根。党参（E错）：【来源】为桔梗科植物党参、素花党参或川党参的干燥根。